为了加强患者对医嘱的记忆，不宜采用的是
A. 医嘱简明只说一次
B. 医嘱书面形式
C. 重要的医嘱先说
D. 让病人复述医嘱
E. 让病人写下来

正确答案：A。医嘱简明只说一次

解析：为了加强患者对医嘱的记忆，可以医嘱书面形式（B对），重要的医嘱先说（C对），让病人复述医嘱（D对），让病人写下来（E对）。不宜医嘱简明只说一次（A错，为本题正确答案）。